牙外伤最常见于
A. 婴幼儿
B. 学龄儿童
C. 青壮年
D. 中老年
E. 妊娠期妇女

正确答案：B。学龄儿童

解析：本题考查牙外伤。牙外伤最常见于学龄儿童（B对）。①牙外伤是指在突然的机械外力作用下，牙体硬组织、牙髓或牙周组织发生急性损伤的一种疾病。②牙外伤多数发生在上前牙，上颌中切牙最多，其次是上颌侧切牙。③牙外伤可单独破坏一种组织，也可使多种组织同时受累。④牙外伤可以发生于各个年龄人群，但儿童及青少年是牙外伤的高发人群。乳牙外伤多发生在10～24个月的幼儿，恒牙牙外伤高发人群是6～13岁的儿童。随着人口老龄化，老年人面临跌倒的风险，牙外伤的发病率也在提高。